药物临床试验机构以健康人为麻醉药品和第一类精神药品临床试验的受试对象的，由药品监管管理部门责令停止违潜行为，给予警告；情节严重的，取消其药物临床试验机构的资格；构成犯罪的，依法追究刑事责任。对受试对象造成损害的，药物临床试验机构依法承担治疗和赔偿责任。“情节严重的，取消其药物临床试验机构的资格”，其中的“取消其药物临床试验机构资格”属于
A. 行政处分
B. 民事责任
C. 刑事责任
D. 行政处罚

正确答案：D。行政处罚

解析：本题考查的是行政处罚的种类。药物临床试验机构以健康人为麻醉药品和第一类精神药品临床试验的受试对象的，由药品监管管理部门责令停止违潜行为，给予警告；情节严重的，取消其药物临床试验机构的资格；构成犯罪的，依法追究刑事责任。对受试对象造成损害的，药物临床试验机构依法承担治疗和赔偿责任。“情节严重的，取消其药物临床试验机构的资格”，其中的“取消其药物临床试验机构资格”属于行政处罚（D对）。行政处罚的原则：（1）处罚法定原则：依照《中华人民共和国行政处罚法》（以下简称《行政处罚法》），公民、法人或者其他组织违反行政管理秩序的行为，应当给予行政处罚的，由法律、法规或者规章规定，并由行政机关依照《行政处罚法》规定的程序实施。没有法定依据或者不遵守法定程序的，行政处罚无效。（2）处罚公正、公开原则：公正，是指公平、正义，其基本精神是要求行政主体及其工作人员办事公道不徇私情，平等地对待不同身份、民族、性别和不同宗教信仰的人。公正是国家活动的一项基本原则，也是公民所应享有的一项基本权利。在行政处罚中，公平原则要求行政主体必须依法裁判，公平地处罚违法的公民、法人或者其他组织，做到同样的违法行为受到同样的处罚，不同的违法行为不应受到同等的处罚。同时，必须以公正而无偏私的程序达到公正的结果。（3）处罚与违法行为相适应的原则：这一原则是指设定和实施行政处罚必须以事实为依据，与违法行为的事实、性质、情节以及社会危害程度相当。（4）处罚与教育相结合的原则：实施行政处罚，纠正违法行为，应当坚待处罚与教育相结合，教育公民、法人或者其他组织自觉守法。处罚不是目的，而是手段，通过处罚达到教育的目的。（5）不免除民事责任（B错），不取代刑事责任（C错）原则：这一原则是指公民、法人或者其他组织因违法受到行政处罚，其违法行为对他人造成损害的，应当承担民事责任。违法行为构成犯罪，应当依法追究刑事责任，不得以行政处罚代替刑事处罚。行政处罚的种类：《中华人民共和国行政处罚法》第八条明确规定了行政处罚的种类，可归为以下四类。（1）人身罚：是指特定行政主体限制和剥夺违法行为人人身自由的行政处罚，如行政拘留。《行政处罚法》规定，“限制人身自由的行政处罚，只能由法律设定”。《药品管理法》规定，对生产销售假药和生产销售劣药情节严重的，以及伪造编造许可证件、骗取许可证件等情节恶劣的违法行为，可以由公安机关对相关责任人员处五日至十五日的拘留。（2）资格罚：是指行政主体限制、暂停或剥夺作出违法行为的行政相对人某种行为能力或资格的处罚措施。根据《行政处罚法》规定，资格罚主要包括责令停产停业、吊销许可证或者执照等。《药品管理法》规定的行政处罚中的资格罚包括：吊销药品批准证明文件、吊销药品生产许可证、吊销药品经营许可证、吊销医疗机构执业许可证、撤销检验资格、责令停产、停业，药物非临床安全性评价研究机构、药物临床试验机构一定期限内不得开展药物非临床安全性评价研究、药物临床试验，吊销执业证书等。另外，《药品管理法》规定生产、销售假药，或者生产、销售劣药且情节严重的法律责任，对违法企业的法定代表人、主要负责人、直接负责的主管人员和其他责任人员进行从业资格限制，终身禁止从事药品生产经营活动；对生产销售假药被吊销许可证的企业，十年内不受理其相应申请；规定伪造、变造、出租、出借、非法买卖许可证或者药品批准证明文件，提供虚假的证明、数据、资料、样品或者采取其他手段骗取临床试验许可、药品生产许可、药品经营许可、医疗机构制剂许可或者药品注册等许可，未遵守药品生产质量管理规范、药品经营质量管理规范、药物非临床研究质量管理规范、药物临床试验质量管理规范等且情节严重的法律责任，对违法企业的法定代表人、主要负责人、直接负责的主管人员和其他责任人员，十年直至终身禁止从事药品生产经营等活动。（3）财产罚：是指行政主体依法对违法行为人给予的剥夺财产权的处罚形式。财产罚是运用最广泛的一种行政处罚，其形式主要有罚款和没收财物（没收违法所得、没收非法财物等）两种。罚款，是行政主体依法强制违法行为人在一定期限内交纳一定数额货币的一种处罚方式，《药品管理法》中运用相当广泛。没收违法所得、没收非法财物，是行政主体依法将违法行为人的违法所得、违禁物品、违法行为工具等强制收归国有的一种处罚形式。以强制手段剥夺违法行为人的财产权，以此达到惩罚目的。药品行政处罚中的没收内容包括没收非法财物（药品、假药、劣药）、没收违法所得、没收与违法行为有关的其他财物等。（4）声誉罚：是指对违法者的名誉、荣誉、信誉或精神上的利益造成一定损害的处罚方式，是行政处罚中最轻的一种，具体形式主要有警告和通报批评两种。《行政处罚法》中设置的声誉罚只有警告，是指行政主体对实施了违法行为但情节较为轻微并造成实际危害后果的相对人的谴责和警戒。《药品管理法》第80条、第84条、第85条、第86条等都有“给予警告”的规定。行政处分（A错）：指由有管辖权的国家机关或企事业单位依据行政隶属关系对违法失职人员给予的一种行政制裁。其种类主要有警告、记过、记大过、降级、撤职、开除六种。